患者，男，48岁。背部生疮，初起肿块上有一粟粒样脓头，抓破后局部肿痛加剧，色红灼热，脓头相继增多，溃后如蜂窝状，伴有寒热头痛，纳呆，便秘，溲赤，舌质红，苔黄，脉弦数。其诊断是
A. 疔
B. 疖
C. 有头疽
D. 发
E. 痈

正确答案：C。有头疽

解析：该题考查疮疡的鉴别诊断。该患者疮生于背部，肿块上有脓头，抓破后局部肿痛加剧，色红灼热，脓头相增多，溃后如蜂窝状，符合有头疽的临床表现（C对）。